60kg体重的正常成年人的血量为
A. 2.8～4.0L
B. 4.2～4.8L
C. 5.0～7.0L
D. 7.0～8.0L
E. 10.0～20.0L

正确答案：B。4.2～4.8L